自汗、盗汗并见，其病机是
A. 精血亏虚
B. 阴阳两虚
C. 阳气不足
D. 津液不足
E. 以上均非

正确答案：B。阴阳两虚

解析：精血亏虚，化汗乏源，可致里证无汗（A错）。阴虚则内热，入睡则卫阳由表入里，肌表不固，内热加重，蒸津外泄而汗出，见盗汗。自汗常见于气虚证和阳虚证，阳虚多在气虚的基础上发展而来。阳气亏虚，不能固护肌表，玄府不密，津液外泄，可见自汗，故自汗可见于气阴两虚证和阴阳两虚证（B对）。阳气不足，不能固护肌表，玄府不密，津液外泄，可见自汗（C错）。津液不足，化汗乏源，可见少汗或无汗（D错）。阴阳两虚选项正确，故（E错）。